龈上洁治术正确的操作应是
A. 改良握笔式执持器械
B. 支点松弛远离术区
C. 洁治器的刃部多放在牙石中部
D. 层层刮削牙石
E. 用力方向向根方

正确答案：A。改良握笔式执持器械

解析：本题考查龈上洁治术的操作。龈上洁治术正确的操作应是改良握笔式执持器械（A对）。龈上洁治术应是改良握笔式执持器械，即以中指指腹放在洁治器颈部，以中指或中指加无名指放于洁治牙附近的牙做支点，以腕部发力刮除牙石。支点必须要稳，利于发力，也避免损伤周围组织；支点松弛远离术区（B错）则刮除时支点不稳会损伤软硬组织，且力矩过长费力。洁治器的刃部应放在牙石的根方，向（牙合）面方向用力，力求将牙石整块从牙面刮下，避免层层刮削（D错），这样费时费力且洁治不彻底；放在牙石中部（C错）进行洁治不能很好的施力，且易导致牙石不能完整刮除；用力方向向根方（E错）会将牙石或其他细菌性碎屑推入牙周袋深部造成牙周组织损伤，引起炎症反应，影响愈合。